学校健康教育的核心是
A. 传播健康知识
B. 传授健康技能
C. 提高学生健康信念
D. 使学生养成健康的生活方式
E. 促进学生生长发育

正确答案：D。使学生养成健康的生活方式